病原体不断侵入血液，并在血液中繁殖产生毒素，表现在严重中毒症状时，应诊断为
A. 毒血症
B. 菌血症
C. 败血症
D. 脓毒血症
E. 变应性亚败血症

正确答案：C。败血症